已被用于人乳头瘤病毒（HPV）疫苗和乙型肝炎预防性疫苗为
A. DCs
B. AS04
C. MF58
D. MF59
E. IL-18

正确答案：B。AS04

解析：本题考查抗原基本概念、分类、超抗原及佐剂。AS04（B对）已被用于人乳头瘤病毒（HPV）疫苗和乙型肝炎预防性疫苗。